男，32岁。右大腿枪弹伤4小时。伤口已经在院外经过初步处理。查体：T37.8℃，P141次/分，R28次/分，BP72/43mmHg。面色苍白，呼吸急促。双肺呼吸音清晰，心律齐。腹软，无压痛。大腿中下1/3处对穿性伤口，已经用纱布覆盖包扎，无明显渗血。足背动脉搏动弱。该患者首要的处理措施是
A. 拆开纱布，检查伤口
B. 急诊清创缝合
C. 注射TAT
D. 建立静脉通道，补充血容量
E. DSA检查了解有无血管损伤

正确答案：D。建立静脉通道，补充血容量

解析：患者枪弹伤后面色苍白，查体：P141次/分，BP72/43mmHg（收缩压≤90mmHg提示失血性休克可能），休克指数（脉率/收缩压）为1.95（休克指数＞1.0～1.5提示有休克），提示存在休克。此时该患者应首先纠正休克，即首要的处理措施是建立静脉通道，补充血容量（D对）。拆开纱布，检查伤口（A错）、急诊清创缝合（B错）、注射TAT（C错）、DSA检查了解有无血管损伤（E错）均应在纠正休克后进行。